厌食的主要病机是
A. 脾失健运，乳食不化
B. 暑湿内伤，脾为湿困
C. 脾胃虚弱，纳化无权
D. 肝郁气滞，乘脾犯胃
E. 脾胃失健，纳化不和

正确答案：E。脾胃失健，纳化不和

解析：本病多由喂养不当、他病伤脾、先天不足等引起，其病变脏腑主要在脾胃。胃司受纳，脾主运化，脾胃调和，则口能知五谷饮食之味。若脾胃失健，纳化不和，则造成厌食。本病应以脏腑辨证为纲，主要从脾胃辨证，区别是以运化功能失健为主，还是以脾胃气阴亏虚为主（E对）。脾失健运，乳食不化是积滞的主要病机（A错）。夏伤暑湿，脾为湿困，使受纳运化失常（B错）。积滞的病机示脾胃虚弱，腐熟运化不及，乳食停滞不化，纳化无权（C错）。小儿肝郁气滞证少见（D错）。